创伤（牙合）是指
A. 高陡的牙尖引起牙周创伤
B. 咬合关系不良所致
C. 有早接触的（牙合）关系
D. 错（牙合）
E. 引起牙周损伤的（牙合）关系

正确答案：E。引起牙周损伤的（牙合）关系

解析：本题考查创伤（牙合）。创伤（牙合）是指引起牙周损伤的（牙合）关系（E对）。异常的（牙合）关系包括高陡的牙尖（A错），咬合关系不良（B错），有早接触的（牙合）关系（C错），错（牙合）（D错），这些异常（牙合）关系易引起牙周损伤。